男性，35岁。双下肢水肿2周。查体：血压130/80mmHg，双下肢轻度凹陷性水肿。尿常规：蛋白++++，红细胞++。Scr122μmol/L。血浆白蛋白28g/L。若为上述病理类型，首选治疗药物为
A. 环磷酰胺
B. 环孢素A
C. 霉酚酸酯
D. 糖皮质激素
E. 硫唑嘌呤

正确答案：D。糖皮质激素

解析：肾病综合症患者，肾活检示肾小球系膜轻度增生，对糖皮质激素及细胞毒药物的治疗反应好。因此，首选治疗药物为（D对）。若患者无激素禁忌症及激素抵抗或依赖，一般不考虑使用细胞毒药物。环磷酰胺（A错）、环孢素A（B错）、霉酚酸酯（C错）、硫唑嘌呤（E错）均为细胞毒药物，一般不作为首选。